男孩9岁。气喘半日，每年春秋季发病，体温36.5℃，两肺有普遍哮鸣音，白细胞7.6×10⁹/L，中性粒细胞0.76，诊断可能为
A. 喘息性支气管炎
B. 支气管哮喘
C. 过敏性肺炎
D. 急性支气管炎
E. 支气管肺炎

正确答案：B。支气管哮喘

解析：男孩9岁。气喘半日，每年春秋季发病，体温36.5度，两肺有普遍哮鸣音等符合支气管哮喘的诊断标准，且实验室检查结果示白细胞7.6×10⁹/L，中性粒细胞0.76等可排除炎症，故该患儿诊断可为支气管哮喘（B对）。而喘息性支气管炎（A错）是一组临床综合征，泛指一组有喘息表现的婴幼儿急性支气管炎，其诊断标准（年龄＜3岁者）为：①婴幼儿患毛细支气管炎或喘息样支气管炎后反复喘息发作≥3次者2分；②肺部出现哮鸣音者2分；③喘息症状突然发作1分；④患儿有其他过敏史1分；⑤一二级亲属中有湿疹、皮炎或哮喘患病史1分。以上总分＞5分者诊断婴幼儿哮喘喘息发作，只2次或总分≤4分者，初步诊断为喘息性支气管炎，并继续追踪观察，故该患儿不考虑此病。过敏性肺炎（C错）是易感人群反复吸入各种具有抗原性的有机粉尘、低分子量化学物质，引起的一组弥漫性间质性肉芽肿性肺病，与季节性大气污染、室内微生物感染有关，发作时肺部体征与哮喘发作时不同，多无喘鸣音，主要听到的是湿性啰音，故该患儿不考虑此病。急性支气管炎（D错）大多先有上呼吸道感染症状，之后以咳嗽为主要症状，开始为干咳，以后有痰。婴幼儿症状较重，常有发热、呕吐及腹泻等。一般无全身症状。双肺呼吸音粗糙，可有不固定的散在的干啰音和粗中湿啰音，故该患儿不考虑此病。支气管肺炎（E错）一般有发热、咳嗽、呼吸气促的症状，患儿无过敏性体质等，肺部听诊闻及中、细湿啰音和（或）胸部影像学有肺炎的改变均可诊断为此病，故该患儿不考虑此病。